当水源受有机物和细菌严重污染时，应选用的消毒法是
A. 普通氯化消毒法
B. 氯胺消毒法
C. 折点氯消毒法
D. 过量氯消毒法
E. 有效氯消毒法

正确答案：D。过量氯消毒法

解析：本题考查当水源受有机物和细菌严重污染时，应选用的消毒法。当水源受有机物和细菌污染严重时，或在野外工作、行军等条件下，需在短时间内达到消毒效果时，可用过量氯消毒法（D对ABCE错），即加过量氯于水中，使余氯达1～5mg/L。消毒后的水用亚硫酸钠、亚硫酸氢钠、硫代硫酸钠或活性炭脱氯。